消除所有微生物生命状态的过程，即杀灭器械上包括芽胞在内的所有微生物，称为
A. 消毒
B. 灭菌
C. 冲洗
D. 清洁
E. 抗菌

正确答案：B。灭菌

解析：灭菌：是指消除所有微生物生命状态的过程，即杀灭器械上包括芽胞在内的所有微生物，达到无菌状态。掌握“牙髓根尖周病的治疗总论”知识点。